患者，男，45岁。心悸10天，心电图示多个导联提前出现宽大畸形波群，其前无相关P波、其后T波与QRS波群主波方向相反，代偿间歇完全。其诊断是
A. 房性早搏
B. 房室交界性早搏
C. 室性早搏
D. 房室传导阻滞
E. 室内传导阻滞

正确答案：C。室性早搏

解析：室性期前收缩很少能逆传心房，窦房结冲动发放节律未受干扰，因此在宽大畸形的QRS波群前无相关P波，ST段与T波的方向与QRS主波方向相反，提示异搏点来源于心室，应诊断为室性早搏（C对）。房性早搏（A错）的P波提前发生，与窦性P波形态不同，房性早搏下传的QRS波形态通常正常。房室交界性早搏（B错）可前向和逆向传导，分别产生提前发生的QRS波与逆行P波。逆行P波可位于QRS波之前、之中或之后，QRS波形态正常。房室传导阻滞（D错）有正常的P波，QRS波群，但是两者关系不确定。会出现P波后，无QRS波群或者两者各自独立出现的心电图表现。室内传导阻滞（E错）发生在心室内传导中，不会影响P波形态，心电图表现主要是QRS波群的畸形，与T波关系不确定。